急性牙髓炎的疼痛特点为，除外
A. 自发性阵发性疼痛
B. 夜间痛加重
C. 温度刺激疼痛加剧
D. 疼痛不能定位
E. 咬合痛

正确答案：E。咬合痛

解析：急性牙髓炎的临床特点是发病急，疼痛剧烈。检查时多见有深龋等牙体硬组织的实质性缺损，接近牙髓，可见微小穿孔，穿孔处可见浓液或血液渗出，一般到医院来时都是慢性牙髓炎急性发作，疼痛特点如下：①常在夜间发作：只是说白天缓减一些，病人常常从夜间痛醒。②冷热刺激加重：这是区别急性牙髓炎和其他疾病的重要诊断。③疼痛不能定位：病人一般不能明确感觉是哪颗牙齿疼痛，会伴有三叉神经牵涉痛，并伴有放射性疼痛。④阵发痛：在没有外界刺激的情况下，患牙有无规律性的持续性疼痛，持续时间不定。临床上绝大多数属于慢性牙髓炎急性发作的表现，龋源性者尤为显著。无慢性过程的急性牙髓炎多出现在牙髓受到急性的物理损伤、化学刺激以及感染等情况下，如手术切割牙体组织等导致的过度产热、充填材料的化学刺激等。掌握“可复性、急慢性牙髓炎”知识点。